视觉传导通路
A. 起自视网膜双极细胞
B. 视交叉处不完全交叉
C. 视网膜颞侧半纤维交叉
D. 经内囊膝投射至视觉中枢
E. 止于内侧膝状体

正确答案：B。视交叉处不完全交叉

解析：视觉传导通路由三级神经元组成。起自眼球视网膜神经部外层的视锥细胞和视杆细胞（A错）。第一级神经元为视网膜内的双极细胞。第二级神经元为视网膜内的节细胞，由节细胞发出的轴突形成视神经，经视神经管进入颅腔。在视交叉处，来自两眼视网膜颞侧半的纤维左右交叉，两眼鼻侧半交叉后的纤维（C错）和颞侧半不交叉的纤维形成左、右视束（B对），止于第三级神经元即外侧膝状体（E错）。然后发出纤维组成视辐射（E对），经内囊后肢投射至距状沟周围皮质（D错）。